用CCl₄给大鼠经呼吸道感染后，测试大鼠血清中GPT升高，CCl₄所发生的GPT改变为
A. 效应
B. 反应
C. 剂量-效应（反应）关系
D. 有的个体不遵循剂量（效应）反应关系规律

正确答案：A。效应

解析：本题考查效应。效应又称量反应，表示暴露一定剂量外源化学物后所引起的一个生物个体、器官或组织的生物学改变。用CCl₄给大鼠经呼吸道感染后，测试大鼠血清中GPT升高，CCl₄所发生的GPT改变为效应（A对BCD错）。